心气大伤可见
A. 谵语
B. 呓语
C. 独语
D. 郑声
E. 口吃

正确答案：D。郑声

解析：郑声指神识不清，语言重复，时断时续，语声低弱模糊，可见于心气大伤（D对）。谵语（A错）指神识不清，语无伦次，声高有力，属实证，多因热扰心神所致。呓语（B错）指睡梦中说话，吐字不清，意思不明的症状，多因心火、胆热或胃气不和所致，久病虚衰出现呓语，称为虚呓，多为神不守舍所致。独语（C错）指自言自语，喃喃不休，见人语止，首尾不续，多因心气不足，神失所养，或气郁痰阻，蒙蔽心神所致，属阴证，常见于癫病、郁病。口吃（E错）为语謇之一，指神志清楚，思维正常，但语言不流利，或吐字不清者，因习惯而成者称为口吃，不属病态；病中语言謇涩，每与舌强并见者，多因风痰阻络所致，为中风之先兆或中风后遗症。